可用于缓解急性哮喘发作的药是
A. 异丙肾上腺素
B. 碱羟胺
C. 心得安
D. 去甲肾上腺素
E. 多巴胺

正确答案：A。异丙肾上腺素

解析：异丙肾上腺素应用于支气管哮喘，用于控制支气管哮喘急性发作，舌下或喷雾给药，起效快，作用强（A对）。